“必先岁气，无伐天和”是说明
A. 因时制宜
B. 因地制宜
C. 因人制宜
D. 审因论治
E. 以上都不是

正确答案：A。因时制宜

解析：四时与人体健康的关系非常密切，在预防保健方面特别强调气象因素的重要性，正如《黄帝内经》中记载的“必先岁气、无伐天和”，就是在治病时首先明确一年的天气变化情况，在预防保健中必须充分考虑气象因素和季节、节气的变化，以顺应自然规律，因时制宜（A对）达到强身健体、祛病延年的目的。